关于真实性指标、患病率与预测值的关系，以下说法正确的是
A. 当灵敏度与特异度一定，疾病患病率降低，阳性预测值下降
B. 当灵敏度与特异度一定，疾病患病率升高，阴性预测值升高
C. 当人群患病率不变时，灵敏度升高，特异度降低，阳性预测值升高
D. 当人群患病率不变时，灵敏度升高，特异度降低，阴性预测值下降
E. 当人群患病率不变时，灵敏度降低，特异度升高，阳性预测值降低

正确答案：A。当灵敏度与特异度一定，疾病患病率降低，阳性预测值下降

解析：本题考查筛检中预测值与真实性指标，现患率的关系。筛检试验的灵敏度、特异度和目标人群的疾病患病率都会影响预测值的大小。当灵敏度与特异度一定，疾病患病率降低，阳性预测值降低（A对B错），阴性预测值升高。当人群患病率不变时，灵敏度升高，特异度降低，阳性预测值下降，阴性预测值升高（CDE错）。